属于5-HT₃受体拮抗剂的有
A. 盐酸格拉司琼
B. 甲氧氯普胺
C. 托烷司琼
D. 多潘立酮
E. 盐酸昂丹司琼

正确答案：A、C、E。盐酸格拉司琼；托烷司琼；盐酸昂丹司琼

解析：本题考查5-HT₃受体拮抗剂。盐酸格拉司琼（A对）、托烷司琼（C对）和盐酸昂丹司琼（E对）均为5-HT₃受体拮抗剂的代表药物。通过阻断5-HT₃受体产生高效、强效的镇吐作用，临床上广泛用于防止癌症化疗、放疗、麻醉、术后所引起的恶心和呕吐。甲氧氯普胺（B错）和多潘立酮（D错）为多巴胺D₂受体拮抗剂。